位于牙齿切缘和牙尖处，可以增强釉质抵抗咬合力的结构是
A. 绞釉
B. 施雷格线
C. 无釉柱釉质
D. 釉小皮
E. 釉面横纹

正确答案：A。绞釉

解析：绞釉的釉柱自釉牙本质界至牙表面的行程并不完全呈直线，在牙齿切端及牙尖处缠绕更为弯曲明显，可以增强釉质对咬合力的抵抗。掌握“牙釉质”知识点。